以下可引起微小病变型肾病的药物
A. 血管紧张素转换酶抑制剂
B. 氨基糖苷类
C. 非甾体类抗炎药
D. 环孢素A
E. 磺胺类药物

正确答案：C。非甾体类抗炎药

解析：血管紧张素转化酶抑制剂、氨基糖苷类、非甾体抗炎药、环孢素A、磺胺类药物均可引起肾毒性（ABDE错），但非甾体抗炎药可引起微小病变型肾病（C对）。